妊娠妇女治疗口腔疾病的适宜时期是
A. 1～3个月
B. 3～6个月
C. 4～6个月
D. 5～7个月
E. 3～5个月

正确答案：C。4～6个月

解析：本题考查妊娠期妇女口腔保健内容。妊娠妇女治疗口腔疾病的适宜时期是4～6个月（C对）。口腔疾病可以选择在孕中期（4～6个月）进行治疗，这是相对安全期。妊娠期要尽量避免X线照射，如果必须进行X线检查，腹部应进行必要的防护，最好避开妊娠期的前3个月。怀孕早期和晚期接受口腔治疗，会因为紧张和疼痛增加流产或早产的风险。妊娠期后3个月，胎儿的增大会影响母亲的体位，不便进行口腔治疗。妊娠后发病早期应对症治疗，出现全身症状时，须在医师指导下，合理用药防止感染扩散。